葡萄糖注射液的含量测定方法是
A. 亚硝酸钠滴定法
B. 碘量法
C. 汞量法
D. 高效液相色谱法
E. 旋光度法

正确答案：E。旋光度法

解析：本题考查旋光度。葡萄糖注射液的含量测定方法是旋光度法（E对）。葡萄糖具有旋光度，首选旋光度测定法。亚硝酸钠滴定法（A错）是亚硝酸钠在盐酸存在条件下与具有芳伯氨基化合物发生重氮化反应，定量生成重氮盐。碘量法（B错）是以碘作为氧化剂，或以碘化钾作为还原剂，进行氧化还原滴定的方法。汞量法（C错）是利用二价汞盐与卤素反应生成络合物的滴定分析方法。高效液相色谱法（D错）高效液相色谱适于分析高沸点不易挥发的、受热不稳定易分解的、相对分子质量大、不同极性的有机化合物；生物活性物质和多种天然产物；合成的和天然的高分子化合物等。